达到最大强度运动时的心率称
A. 心率
B. 最大心率
C. 靶心率
D. 10秒心率
E. 1分钟心率

正确答案：B。最大心率